活化的凝血因子Ⅻ可直接引起下列哪种效应？
A. 使凝血酶原变为凝血酶
B. 使血小板活性增强，促进其聚集
C. 使激肽释放酶原转变为激肽释放酶
D. 使纤维蛋白溶解酶原转变为纤维蛋白溶解酶
E. 促使组织凝血活酶的释放

正确答案：C。使激肽释放酶原转变为激肽释放酶

解析：使激肽释放酶原转变为激肽释放酶（C对）是活化的凝血因子Ⅻ可直接引起的效应，激肽释放酶使纤溶酶原变成纤溶酶，激活纤溶系统。使凝血酶原变为凝血酶（A错）的是凝血酶原激活物。使血小板活性增强，促进其聚集（B错）的是胶原，除外凝血酶、ADP、肾上腺素、血栓素A 2、血小板活化因子等也可作为血小板的激活剂与血小板表面的相应受体结合，使血小板活化并释放内源性ADP和血栓素A 2 , 进而促使血小板发生不可逆性聚集，形成血小板血栓。使纤维蛋白溶解酶原转变为纤维蛋白溶解酶（D错）的是纤维蛋白溶解酶原激活物。促使组织凝血活酶的释放（E错）的是细胞损伤后。